卡环臂尖端位于基牙舌面倒凹区时，与远中支托相连，转向近中颊侧通过连接体与基托相连者称
A. 三臂力卡
B. 对半卡环
C. 延伸卡环
D. 反回力卡
E. RPA力卡

正确答案：D。反回力卡

解析：卡环臂尖端位于基牙舌面倒凹区时，与远中支托相连，转向近中颊侧通过连接体与基托相连者称反回力卡。两者均为铸造卡环，由于远中支托不与基托相连接，（牙合）力则通过人工牙和基托传到黏膜和颌骨上，减轻基牙的负荷，起应力中断的作用。掌握“局部义齿固位体”知识点。